强心苷中毒的室性心律失常用
A. 奎尼丁
B. 苯妥英钠
C. 普鲁卡因胺
D. 普萘洛尔
E. 维拉帕米

正确答案：B。苯妥英钠

解析：本题考查强心苷的中毒解救。苯妥英钠（B对）常用来治疗强心苷中毒引起的室性心律失常。奎尼丁（A错）通过抑制钠离子内流治疗心律失常，强心苷中毒主要为胞内钙离子浓度过高，奎尼丁不可用于治疗。普鲁卡因胺（C错）主要治疗心房颤动、心房扑动，用于危及生命的室性心律失常。普萘洛尔（D错）用于治疗多种原因所致的心律失常,如房性及室性早搏、窦性及室上性心动过速、心房颤动等。维拉帕米（E错）为钙离子通道阻滞剂，是治疗阵发性室上型心律失常的首选药。